血浆晶体渗透压主要来自血浆的
A. 葡萄糖
B. Na⁺
C. 纤维蛋白
D. 球蛋白
E. 清蛋白

正确答案：B。Na⁺